有关全身性感染致病菌的描述正确的是
A. 革兰阳性球菌感染多表现低温低白细胞低血压
B. 厌氧菌感染多为一般细菌感染后的二重感染
C. 革兰阳性球菌感染多为克雷伯杆菌
D. 革兰阴性杆菌感染多数抗生素均可杀菌和消除内毒素
E. 革兰阳性球菌感染倾向于血液播散，形成转移性脓肿

正确答案：E。革兰阳性球菌感染倾向于血液播散，形成转移性脓肿

解析：金黄色葡萄球菌进入血液，可随血液循环播散至各处，在局部繁殖的金葡菌因多数致病菌株可产生凝固酶，引起周围纤维蛋白沉积和凝固，又使得各处感染易于局限化，形成脓肿（E对）。革兰染色阴性杆菌的主要毒性在于内毒素，多数抗生素虽然能杀菌，但对内毒素及其介导的多种炎症无效（D错），因此革兰阴性杆菌导致的脓毒症一般比较严重，可出现低温、低白细胞、低血压的三低现象（A错）。二重感染多因为长期使用广谱抗生素，导致局部菌群失调，主要病原菌为真菌（B错）。革兰阳性球菌感染（P114）多为金黄色葡萄球菌、表皮葡萄球菌及肠球菌，克雷伯杆菌为革兰阴性菌（C错）。